高位截瘫病人急性期排尿障碍表现为
A. 尿失禁
B. 尿潴留
C. 无尿
D. 尿崩症
E. 少尿

正确答案：B。尿潴留

解析：高位截瘫即高位的脊髓横贯性损害，表现出受损平面以下各种感觉缺失、迟缓性瘫痪、肌张力减弱、腱反射减弱、病理反射阴性等的下运动神经元性瘫痪及括约肌障碍的尿潴留（B对A错）等。尿潴留并非无尿（C错）或少尿（E错），尿潴留表现为尿的生成可正常而排泄不畅，无尿或少尿则是尿的生成减少而排泄可正常。尿崩症（D错）见于抗利尿激素的合成障碍或利用障碍，有下丘脑垂体性尿崩和肾性尿崩。